降压反射的生理意义是
A. 降低动脉血压
B. 升高动脉血压
C. 减弱心血管活动
D. 增强心血管活动
E. 维持动脉血压相对稳定

正确答案：E。维持动脉血压相对稳定